根据《灵枢·顺气一日分为四时》记载，病在脏者，取之
A. 井
B. 荥
C. 输
D. 经
E. 合

正确答案：A。井

解析：《灵枢·顺气一日分为四时》云：“病在脏者，取之井（A对）；病变于色者，取之荥；病时间时甚者，取之输；病变于音者，取之经；经满而血者，病在胃及以饮食不节得病者，取之于合”。“《难经·六十八难》做了补充：“井主心下满，荥主身热，输主体重节痛，经主喘咳寒热，合主逆气而泄”。综合现代临床的应用情况，井穴多用于急救，荥穴主要用于治疗热证，输穴多主脏病，经穴多主经脉循行部位痛证，合穴多主腑病。